一位年轻女性，2年来反复发作外阴阴道假丝酵母菌病（VVC），最近准备怀孕，非常担心和苦恼，来咨询该病的病因及防治，以下的解释和处理哪项错误
A. 应询问她有无糖尿病，是否经常使用抗生素
B. 询问她是否有肛周炎、手足癣等，假丝酵母病可由此感染
C. 首选阴道内用药，如制霉菌素或克霉唑栓剂等
D. 顽固病例或阴道用药不便者，可用口服药如氟康唑等治疗
E. 应勤换内裤，用过的内裤、盆及毛巾用开水烫洗

正确答案：B。询问她是否有肛周炎、手足癣等，假丝酵母病可由此感染